乙酰水杨酸
A. 抗炎作用很弱
B. 对癌症疼痛无效
C. 一般剂量即可延长出血时间
D. 不可用于关节强直性脊椎炎
E. 增加血小板血栓素（TXA2）合成

正确答案：C。一般剂量即可延长出血时间

解析：本题考查阿司匹林的药理作用与临床应用。乙酰水杨酸一般剂量即可延长出血时间（C对），因其可不可逆地抑制血小板COX，减少血小板中血栓素A2（TXA2）的生成，影响血小板的聚集及抗血栓形成（E错）。乙酰水杨酸对COX-1和COX-2均有较强大的抑制作用，具有较强的抗炎作用（A错）。根据癌痛的三阶梯疗法，第一阶梯，轻度疼痛时，可选用非阿片类镇痛药，如阿司匹林（B错）；也可选用胃肠道反应较轻的布洛芬和对乙酰氨基酚。关节强直性脊椎炎的药物治疗，推荐阿司匹林作为有疼痛和晨僵的强直性脊柱炎的一线用药，对于有持续性活动性症状的患者倾向于用阿司匹林维持治疗（D错）。